根除Hp感染后，用C13法复查需要在治疗多少周后
A. 1周
B. 2周
C. 3周
D. 4周
E. 5周

正确答案：D。4周

解析：检测幽门螺旋杆菌的非侵入方法常用13C～14C-尿素呼气试验，该检查不依赖内镜，病人依从性好，准确性较高。但Hp-UBT然存在一定的缺陷，其结果的判定受到抗生素、铋剂、抑酸药物的干扰，因此，对有并发症和经常复发的PU的病人，应追踪抗Hp的疗效，应在治疗至少4周后复检Hp，故在治疗后4周进行复查（D对），避免在应用PPI或抗生素期间复检Hp出现假阴性结果。